脉来缓而时止，止无定数者，称为
A. 结脉
B. 促脉
C. 代脉
D. 微脉
E. 弱脉

正确答案：A。结脉

解析：该题考查常见脉象的特征。结脉的特点为脉来缓慢，时有一止，止无定数（A对）。